急性氟中毒的处理原则是
A. 静坐
B. 给氧
C. 催吐洗胃
D. 注射肾上腺素
E. 不采取任何处理

正确答案：C。催吐洗胃

解析：急性氟中毒：一次性大量误服氟化物，可造成急性氟中毒，主要症状是恶心、呕吐、腹泻甚至肠道出血等；重者引起心、肝、肾器质性损害，以致昏迷。患者通常可在4小时内或死亡、或康复，这一关键时期是非常短的。急救处理原则是催吐洗胃、口服或静脉注射钙剂、补糖、补液以及对症治疗。掌握“氟毒性及氟牙症”知识点。